肺下界与肩胛线相交于
A. 第6肋
B. 第8肋
C. 第10肋
D. 第11肋
E. 第12肋

正确答案：C。第10肋

解析：肺下界与肩胛线相交于第10肋（C对）。